医师在执业活动中除正当治疗外，不得使用
A. 保健药品
B. 消毒药剂
C. 有禁忌证的药品
D. 副作用大的药品
E. 麻醉药品

正确答案：E。麻醉药品

解析：医师应当使用经国家有关部门批准使用的药品、消毒药剂和医疗器械。除正当诊断治疗外，不得使用麻醉药品、医疗用毒性药品、精神药品和放射性药品。掌握“医师执业规则及培训、考核及法律责任”知识点。